医疗机构根据本单位临床需要，经批准可以配制制剂。下列符合医疗机构制剂室设置条件的是
A. 与其他医疗机构共用配制场所、配制设备及检验设施
B. 必须由医疗机构药学部与提出临床需要的临床科室共同设立
C. 制剂室负责人可以由药品生产企业质量负责人兼任
D. 有能够保证制剂质量的设施、管理制度、检验仪器和卫生环境

正确答案：D。有能够保证制剂质量的设施、管理制度、检验仪器和卫生环境

解析：本题考查医疗机构制剂室的设立条件。医疗机构根据本单位临床需要，经批准可以配制制剂。下列符合医疗机构制剂室设置条件的是有能够保证制剂质量的设施、管理制度、检验仪器和卫生环境（D对）。《药品管理法》规定，医疗机构配制制剂，应当有能够保证制剂质量的设施、管理制度、检验仪器和卫生环境。制剂室负责人、药检室负责人、制剂质量管理组织负责人应当为本单位在职药学专业人员，且制剂室负责人和药检室负责人不得互相兼任（C错）。医疗机构不得与其他单位共用配制场所、配制设备及检验设施等（A错）。